药物在适当剂量时只对少数器官或组织产生明显作用，这种特性称为
A. 安全性
B. 有效性
C. 耐受性
D. 选择性
E. 敏感性

正确答案：D。选择性

解析：药物的选择性（D对）是指给予适当剂量的药物时，仅对少数器官或组织产生作用或对少数器官或组织的作用较强，药物选择性高，作用范围窄，不良反应少，药物选择性低，作用范围广，临床应用多，不良反应也多。药品的安全性（A错）是指使用过程中以及使用后有引起不良反应或严重不良反应的情况，可理解为副作用情况。药物的有效性（B错）又称为药物的疗效，是指药物作用的结果有利于改变病人的生理、生化功能或病理过程，使患者机体恢复正常。耐受性（C错）是指连续多次用药后反应性降低，增加剂量可恢复反应，停药后耐受性消失，再次连续用药又可发生。一种抗生素如果以很小的剂量便可抑制、杀灭致病菌，则称为该种致病菌对该微生物"敏感"（E错），反之，则成为"不敏感"或"耐药"，为了解致病菌对哪种抗生素敏感，以合理用药，减少盲目性。可进行敏感性实验。